在细菌生长过程中，细菌生长最快，生物学性状最典型的阶段是
A. 退缓期
B. 对数期
C. 减数期
D. 稳定期
E. 衰退期

正确答案：B。对数期